掌浅弓由下列动脉构成
A. 尺动脉终支和桡动脉终支
B. 尺动脉终支和桡动脉掌浅支
C. 桡动脉终支和尺动脉掌浅支
D. 桡动脉终支和尺动脉掌深支
E. 尺动脉掌浅支和桡动脉的掌浅支

正确答案：B。尺动脉终支和桡动脉掌浅支

解析：尺动脉终支和桡动脉掌浅支（B对）吻合形成掌浅弓。